滑膜囊
A. 为封闭的结缔组织囊
B. 多位于肌腱和骨摩擦处
C. 可与关节腔相通
D. 内有滑液，起减少摩擦的作用
E. 以上都对

正确答案：E。以上都对

解析：滑膜囊为关节囊的滑膜层穿过纤维层向外呈囊状的膨出，是封闭的结缔组织囊（A对），有的与关节囊相连相通（C对），有的则完全独立与关节囊不相通。它们常位于肌腱和骨摩擦处（B对）。滑膜囊大小不等，由直径数毫米至数厘米。囊内有少量滑液，有增加滑润，减少摩擦（D对 E为本题正确答案），促进运动灵活等作用。